奏效最为迅速的给药方法是
A. 皮下注射
B. 肌内注射
C. 皮肤给药
D. 静脉注射
E. 直肠给药

正确答案：D。静脉注射